足临泣是八脉交会穴中
A. 通任脉的穴位
B. 通督脉的穴位
C. 通冲脉的穴位
D. 通带脉的穴位
E. 通阳跷脉的穴位

正确答案：D。通带脉的穴位

解析：本题考查八脉交会穴。八脉交会穴是十二经脉与奇经八脉相通的八个腧穴。通于任脉的穴位是列缺（A错）。通于督脉的穴位是后溪（B错）。通于冲脉的穴位为公孙（C错）。通于带脉的穴位为足临泣（D对）。通于阳跷脉的穴位是申脉（E错）。记忆：牢记八脉交会八穴歌。